诊断早期原发性肝癌最有意义的检查是
A. 血淀粉酶检测
B. 血清甲胎蛋白检测
C. 腹部CT检查
D. 血CEA
E. 血CRP

正确答案：B。血清甲胎蛋白检测

解析：血清甲胎蛋白检测（B对）为诊断早期原发性肝癌最有意义的检查，在排除妊娠和生殖腺胚胎瘤的基础上，AFP>400ng/ml为诊断肝癌的条件之一。血淀粉酶检测（A错）是诊断急性胰腺炎的常用方法。腹部CT对1cm左右的肝癌检出率可>80%，主要用于体积较大的肝癌的检测。CEA（癌胚抗原）（D错）是一种广谱性肿瘤标志物，可在多种肿瘤中表达，脏器特异性低，在临床上主要用于结直肠癌的复发监测。血CRP（C-反应蛋白）（E错）主要用于急性炎症的辅助诊断。